下列说法正确的是
A. 化学结构决定理化性质及化学活性
B. 化学活性决定理化性质
C. 化学活性由生物活性决定
D. 化学活性和理化性质影响化学结构
E. 化学结构直接决定生物活性

正确答案：A。化学结构决定理化性质及化学活性